男，48岁。摔倒后颈部着地，昏迷30分钟。急诊头颅CT显示双额颞叶高低密度混杂影。最可能的诊断是
A. 硬脑膜下血肿
B. 脑震荡
C. 脑干损伤
D. 蛛网膜下腔出血
E. 脑挫裂伤

正确答案：E。脑挫裂伤

解析：患者中年男性，摔倒后颈部着地，昏迷30分钟（脑挫伤昏迷可持续数分、数分、数小时不等）。急诊头颅CT显示双额颞叶高低密度混杂影（脑挫伤CT表现）。结合该患者症状、影像学检查，考虑对冲伤，最可能的诊断是脑挫伤（E对）。硬脑膜下血肿（A错）表现为进行性意识障碍、颅内高压、CT显示脑表面新月形高密度、混杂密度或等密度影。脑震荡（P188）(B错）于伤后立即出现短暂的意识丧失，一般不超过半小时，CT检查颅内无异常。脑干损伤（C错）时CT示点片状状高密度影，周围脑池狭窄或消失。蛛网膜下腔出血（P208）（D错）患者出现偏瘫、视力视野障碍等症状，CT显示脑沟与脑池密度增高。